下列叙述中，不属于肿瘤特点的是
A. 增生细胞分化程度不一
B. 增生细胞具有多克隆性
C. 增生细胞基因异常
D. 增生细胞不成熟
E. 增生细胞有异型性

正确答案：B。增生细胞具有多克隆性

解析：肿瘤的增生细胞具有单克隆性（B错，为本题正确答案），增生细胞具有多克隆性是非肿瘤性增殖的特点。肿瘤细胞的形态、代谢和功能均有异常，不同程度地失去了分化成熟的能力（D对），因此不同肿瘤的增生细胞分化程度不一（A对），增生细胞与相应正常组织之间的差异，即增生细胞的异型性（E对），是肿瘤的重要特点之一。细胞的正常生长和增殖受许多调节分子的控制，肿瘤的形成与增生细胞内调节分子的基因异常（C对）有关。